氯丙嗪引起的乳房肿大泌乳的原因是
A. 阻断结节-漏斗通路D₂受体
B. 阻断黑质-纹状体通路D₂受体
C. 阻断中脑-边缘系统和中脑-皮层通路的D₂受体
D. 阻断脑干网状结构上行激活系统α受体
E. 阻断M胆碱受体

正确答案：A。阻断结节-漏斗通路D₂受体

解析：氯丙嗪能阻断结节-漏斗DA通路的D₂样受体，使下丘脑催乳素释放抑制因子、卵泡刺激素释放因子、黄体生成素释放因子及ACTH的分泌受到抑制，增加催乳素的分泌，引起乳房肿大及泌乳，抑制促性腺激素，使排卵周期紊乱，性功能下降和糖皮质激素的分泌，应激能力下降（A对）。